女，35岁。间断咳嗽、咳痰伴咯血20年，行HRCT检查示右中叶支气管囊状扩张，其余肺叶未见异常。今日再次咯血，量约200ml。给予静脉点滴垂体后叶素治疗，效果欠佳。该患者宜选择的最佳治疗措施为
A. 静脉滴注鱼精蛋白
B. 换用酚妥拉明静脉滴注
C. 支气管动脉栓塞
D. 支气管镜下止血
E. 手术切除病变肺叶

正确答案：E。手术切除病变肺叶

解析：患者为中年女性，以咳嗽、咳痰伴咯血为主要临床表现，HRCT检查示右中叶支气管囊状扩张（为支气管扩张的典型表现），故可诊断为支气管扩张。患者反复咯血，出血量大，经静脉点滴垂体后叶素等内科治疗不能缓解且病变局限者，换用酚妥拉明静脉滴注（B错）治疗，意义不大，应考虑外科手术（E对）。静脉滴注鱼精蛋白（A错）用于治疗因注射肝素过量所引起的出血。支气管动脉栓塞（C错）用于非局限的支气管扩张，该病人支气管扩张局限在右中叶支气管，故不适宜支气管动脉栓塞。支气管镜下止血（D错）不能达到有效止血的目的。